拔牙术后拔牙创内血块机化开始和最后完成的时间分别是
A. 15分钟，1天
B. 6小时，5天
C. 12小时，10天
D. 24小时，20天
E. 48小时，28天

正确答案：D。24小时，20天

解析：本题考查拔牙创的愈合。拔牙创的正常愈合分为5个主要阶段：拔牙创出血和血凝块形成；血块机化和肉芽组织形成；结缔组织和上皮组织替代肉芽组织；原始的纤维样骨替代结缔组织；成熟的骨组织替代不成熟骨质。拔牙后数小时，牙龈组织收缩，约24h后，来自牙槽骨壁的成纤维细胞向血块内生长，同时来自邻近血管的内皮细胞增殖，形成血管芽，并连成毛细血管网，肉芽组织形成血块机化开始；拔牙后3～4d更成熟的结缔组织开始替代肉芽组织，至20d左右基本完成，血块机化完成。因此血块机化开始和最后完成的时间分别是24小时，20天（D对）。